下颌骨发育来自
A. 第一鳃弓
B. 第二鳃弓
C. 第三鳃弓
D. 第四鳃弓
E. 第五鳃弓

正确答案：A。第一鳃弓

解析：下颌骨发育来自第一鳃弓。掌握“唾液腺与颌骨的发育”知识点。